外科内治三原则中的补法适用于
A. 一切肿疡初期
B. 肿疡疮形已成者
C. 溃疡中期，正虚毒盛者
D. 溃疡后期，疮口难敛者
E. 外科非化脓性肿块性疾病

正确答案：D。溃疡后期，疮口难敛者

解析：中医外科内治原则包括消法、托法和补法。补法适用于溃疡后期，此时毒势已去，精神衰疲，气血虚弱，脓水清稀，肉芽灰白不实，疮口难敛（D对）。消法是运用不同的治疗方法和方药，使初起的肿疡邪毒不至结聚成脓而得到消散的治法，是一切肿疡初起（A错）的治法总则。此法适用于尚未成脓的初期肿疡和非化脓性肿块性疾病（E错），以及各种皮肤疾病。托法适用于外疡中期即成脓期，疮形已成（B错），此时热盛肉腐成脓，由于一时疮口不能溃破，或机体正气虚弱无力托毒外出，均会导致脓毒滞留。治疗上应根据病人体质强弱和邪毒盛衰状况，分为补托和透托两种方法。补托法用于正虚毒盛（C错），正气不能托毒外达，疮形平塌、根脚散漫不收、难溃难腐的虚证；透托法用于毒气虽盛而正气未衰者，可用透脓的药物促其早日脓出毒泻，肿消痛减，以免脓毒旁窜深溃。